引起慢性胃炎的重要原因是
A. 大肠埃希菌
B. 链球菌
C. 铜绿假单胞菌
D. 金黄色葡萄球菌
E. 幽门螺杆菌

正确答案：E。幽门螺杆菌

解析：据现代医学研究，幽门螺旋杆菌感染是引起慢性胃炎最重要的原因（E对）。而其他的菌感染则与慢性胃炎无关。